胆汁酸合成的关键酶是
A. 3-α羟化酶
B. 6-α羟化酶
C. 5-α羟化酶
D. 4-α羟化酶
E. 7-α羟化酶

正确答案：E。7-α羟化酶

解析：胆汁酸合成的限速酶是胆固醇7ɑ-羟化酶（E对）。肝细胞合成胆汁酸的反应步骤较复杂，胆固醇首先在胆固醇7ɑ-羟化酶的催化下生成7ɑ-羟胆固醇。后者向胆汁酸的转化包括固醇核的3ɑ和12ɑ羟化、加氢还原、侧链氧化断裂、加水等多步复杂酶促反应，首先生成24碳的胆烷酰CoA。后者即可水解生成初级游离胆汁酸即胆酸和鹅脱氧胆酸，也可直接与甘氨酸或牛磺酸结合生成相应的初级结合胆汁酸。